患儿，3岁。久泻不止，粪质清稀，形寒肢冷，舌淡苔白，脉细弱。治疗应首选
A. 参苓白术散
B. 七味白术散
C. 参附龙牡汤
D. 附子理中汤
E. 理中丸

正确答案：D。附子理中汤

解析：患儿久泻不止当属泄泻，其偏脾阳虚，故见大便清稀，粪质清稀，形寒肢冷，肾阳虚亦可致此，但没有典型的五更泻，可不用四神丸，故宜温脾补肾，方用附子理中汤（D对）。参苓白术散功可健脾益气，渗湿止泻，用于脾虚泻（A错）。七味白术散功效主要是健脾生津，行气消胀，用于治疗脾胃久虚，津液内耗，呕吐泄泻频作，烦渴多饮（B错）。参附龙牡汤功能挽阴回阳，救逆固脱，用于泄泻之阴竭阳脱证（C错）。理中丸方中无附子，无温补肾阳之功（E错）。